黄精除滋阴润肺外，又能
A. 滋阴除热
B. 补脾益气
C. 凉血止血
D. 清心安神
E. 清肝明目

正确答案：B。补脾益气

解析：本题考查黄精的功效。黄精除滋阴润肺外，又能补脾益气（B对）。黄精【功效】滋阴润肺，补脾益气。石斛【功效】养胃生津，滋阴除热（A错），明目，强腰。小蓟【功效】凉血止血（C错），散瘀消痈。百合【功效】养阴润肺，清心安神（D错）。石决明【功效】平肝潜阳，清肝明目（E错）。